下列选项不属于生物膜的功能的是
A. 隔离功能
B. 生化反应和生命活动的场所
C. 储存功能
D. 内外环境物质交换的屏障

正确答案：C。储存功能

解析：本题考查生物膜的功能。生物膜是把细胞或细胞器与周围环境分隔开来的半透膜，包括细胞膜和细胞器的膜。生物膜具有隔离功能（A对）；是内外环境物质交换的屏障（D对）；是生化反应和生命活动的场所（B对）。储存功能（C错，为本题正确答案）不属于生物膜的功能。